肠溶性固体分散物载体是
A. 羟丙基-β-环糊精
B. 乙基-β-环糊精
C. 聚乙二醇
D. Ⅱ号丙烯酸树脂
E. 甘露醇

正确答案：D。Ⅱ号丙烯酸树脂

解析：本题考查包衣膜型缓释材料。肠溶性固体分散物载体包括纤维素类和聚丙烯酸树脂类（如Ⅱ号丙烯酸树脂）（D对）。羟丙基-β-环糊精（A错）为水溶性环糊精衍生物。乙基-β-环糊精（B错）为疏水性环糊精衍生物。聚乙二醇（C错）可用于长循环脂质体的表面修饰。甘露醇（E错）为片剂常用的稀释剂。